头脑空痛，腰膝酸软者属于
A. 风寒头痛
B. 气虚头痛
C. 血虚头痛
D. 肾虚头痛
E. 风热头痛

正确答案：D。肾虚头痛

解析：患者头脑空痛，多因精髓不足，气血亏虚所致，可判断为头痛虚证，且又伴有腰膝酸软症状可判断为肾虚头痛（D对）。风寒头痛，疼痛剧烈且连项背（A错）；风热头痛，头胀而痛（E错），且两种头痛属于外感实证。气虚头痛，疼痛隐隐，多伴有倦怠乏力，气短自汗（B错）。血虚头痛，头痛而晕，多伴有心悸怔忡，面色少华（C错）。